属于奇经的是
A. 足少阳胆经
B. 十二经别
C. 十二经筋
D. 阴跷脉
E. 十五络脉

正确答案：D。阴跷脉

解析：奇经八脉指督脉、任脉、冲脉、带脉、阴维脉、阳维脉、阴跷脉（D对）、阳跷脉八条。奇经之“奇”含义有二：一指“异”，它们与十二正经不同，既不直属脏腑，除任、督外又无专属穴位和表里配合关系，且“别道奇行”。二指单数，偶之对，因奇经没有表里配合关系。奇经八脉交错地循行分布于十二经之间，具有以下作用：①统率、主导作用②沟通、联络作用③蓄积、渗灌的调节作用。